女，28岁。停经3个月，早孕反应消失，阴道少许流血2天。妇科检查：宫口闭，子宫如妊娠8周大，质软，双侧附件区未触及异常。该患者最可能的诊断是
A. 完全流产
B. 难免流产
C. 流产感染
D. 稽留流产
E. 先兆流产

正确答案：D。稽留流产

解析：该孕妇28岁，停经3个月，早孕反应消失，阴道少许流血2天（稽留流产表现为早孕反应消失，有先兆流产症状或无任何症状，先兆流产主要表现为停经后阴道少量流血和阵发性腹痛），宫口闭（稽留流产妇科检查宫颈口未开），子宫如妊娠8周大（稽留流产子宫小于停经周数，但大于正常非孕子宫），双侧附件区未触及异常，最可能诊断为稽留流产（D对）。先兆流产（P48）（E错）指妊娠28周前出现少量阴道流血，常为暗红色或血性白带，无妊娠物排出，随后出现阵发性下腹痛或腰背痛，妇科检查宫口未开，胎膜未破，子宫大小与停经周数相符。难免流产（P48）（B错）在先兆流产的基础上，阴道流血量增多，阵发性下腹痛加剧，或出现阴道流液，妇科检查宫颈口已扩张，有时可见胚胎组织或胎囊堵塞于宫颈内口，子宫大小与停经周数基本相符或略小。完全流产（P49）（A错）是指妊娠物已全部排出，阴道流血逐渐停止，腹痛逐渐消失，妇科检查宫颈口已关闭，子宫接近正常大小。流产感染（P49）（C错）常因阴道流血时间长，有组织残留于宫腔内或非法堕胎，可表现为盆腔炎、腹膜炎、败血症及感染性休克。